下列疾病，常使气管移向患侧的是
A. 胸膜增厚
B. 大量胸腔积液
C. 胸腔积气
D. 肺气肿
E. 纵隔肿瘤

正确答案：A。胸膜增厚

解析：正常人气管居中。常使气管移向患侧的是胸膜增厚及粘连（A对）。大量胸腔积液（B错）、胸腔积气（C错）、纵隔肿瘤（E错）常使气管移向健侧。肺气肿（D错）患者气管常居中。